激情的特点是
A. 持久且强烈
B. 持久且微弱
C. 积极且短暂
D. 短暂且爆发
E. 积极且稳定

正确答案：D。短暂且爆发